以下不属于抗原提呈细胞的是
A. B淋巴细胞
B. T淋巴细胞
C. 巨噬细胞
D. 树突状细胞（DC）
E. 红细胞

正确答案：E。红细胞